中医认为晚期产后出血的发病机理是
A. 冲任损伤，不能制约经血
B. 气虚失摄，血失所统
C. 冲任不固，气血运行失常
D. 热扰冲任，迫血妄行
E. 血热气逆，冲任失调

正确答案：C。冲任不固，气血运行失常

解析：中医认为晚期产后出血的发病机理为冲任不固，气血运行失常（C对）。崩漏的主要病机是冲任损伤，不能制约经血（A错）；若气虚统摄失司，则可见月经先期，量多，崩漏等病（B错）。胎漏的主要病机为热扰冲任，迫血妄行（D错）；经行吐衄的发病机理是血热气逆，冲任失调（E错）。